男40岁，发现腭部肿胀并破溃2个多月。查：软硬腭交界处见一深在溃疡，可探至骨面，直径1.3cm，形状不规则，界限尚清晰，溃疡边缘隆起。活检显示：组织坏死，涎腺导管和腺泡上皮有鳞状化生。拟诊
A. 腭部鳞癌
B. 口腔结核
C. 腺周口疮
D. 坏死性涎腺化生
E. 腭部腺癌

正确答案：D。坏死性涎腺化生

解析：本题考查坏死性涎腺化生。坏死性涎腺化生（D对）多发生于腭部，尤以软硬腭交界处为多，本病特征为黏膜表面形成火山口样溃疡，溃疡可深达骨面，但不破坏骨组织，溃疡中心坏死，周围黏膜充血，病理检查发现腺小叶坏死，腺导管上皮呈明显的鳞状化生，形成大小不等的上皮岛或上皮条索，根据临床表现和病理变化可判定患者所患疾病为坏死性涎腺化生。腭部鳞癌（A错）多呈外生型，边缘外翻，触之易出血，有时可呈溃疡状，可有骨质破坏，病理检查腭部鳞状上皮增生，无涎腺导管的鳞状化生。口腔结核（B错）所形成的溃疡形状不规则，呈鼠噬状，有肺结核体征。腺周口疮（重型复发性阿弗他溃疡）（C错）溃疡呈弹坑状，有周期性和自限性，病理检查有慢性炎症，无鳞状上皮化生。腭部腺癌（E错）具有高度浸润和破坏性生长特征，损害与周围组织界限不清晰，镜检发现癌细胞异型性明显，结构不一。